运动防护中护牙托的作用叙述不正确的一项是
A. 保护牙齿和口内其他组织
B. 防止颌骨骨折
C. 保护颞下颌关节
D. 预防外力对颅脑的冲击
E. 增大了脑震荡的发生

正确答案：E。增大了脑震荡的发生

解析：护牙托的作用是：①保护牙齿和口内其他组织，如牙龈、颊和唇；②防止颌骨骨折，特别是保护颞下颌关节；③预防外力对颅脑的冲击伤害，降低脑震荡发生的可能；④增强运动员的安全感。掌握“牙外伤的预防”知识点。